既补肾益精，又养血益气的药是
A. 锁阳
B. 狗脊
C. 杜仲
D. 紫河车
E. 冬虫夏草

正确答案：D。紫河车

解析：本题考查紫河车的功效。既补肾益精，又养血益气的药是紫河车（D对）。紫河车【功效】温肾补精，养血益气。锁阳（A错）【功效】补肾阳，益精血，润肠通便。狗脊（B错）【功效】补肝肾，强腰膝，祛风湿。杜仲（C错）【功效】补肝肾，强筋骨，安胎。冬虫夏草（E错）【功效】益肾补肺，止血化痰。